下列疾病患者表现为呼气性呼吸困难的有:
A. 白喉
B. 支气管异物
C. 声带麻痹
D. 气胸
E. 肺纤维化

正确答案：E。肺纤维化

解析：肺纤维化（E对）患者表现为呼气性呼吸困难。